4岁女孩，发热咳嗽5天，呕吐2天，抽搐2次，查体，体温40度，双肺闻及湿啰音，前囟膨隆，颈软，双侧巴氏征（+），脑脊液检查，浑浊，白细胞800×106/L，N：0.8，L：0.2。蛋白质2/L，葡萄糖1.2mol/L，氯化物108mmol/L。该患儿治疗后没好转，前囟膨大，发热，以下哪项操作不合适
A. 物理降温
B. 静脉注射地西泮
C. 腰穿放脑脊液
D. 甘露醇
E. 呋塞米

正确答案：C。腰穿放脑脊液

解析：该患儿最可能诊断的是化脓性脑膜炎，并有严重的颅内压增高，对严重颅内压增高的患儿，在未有效降低颅内压之前，腰椎穿刺有诱发脑疝的危险，应特别谨慎（C错，为本题正确答案）。对症治疗，出现发热情况，可进行物理降温（A对），静脉注射地西泮可治疗由于急性脑功能障碍引起的惊厥发作（B对），应用甘露醇可以降低颅内压，为下一步腰椎穿刺做准备（D对）。呋塞米有利尿作用，可降颅压（E对）。